麻醉同侧下颌舌侧牙龈、黏骨膜、口底黏膜及舌前2/3部分，可行的阻滞麻醉方法是
A. 眶下神经阻滞麻醉
B. 颊神经阻滞麻醉
C. 鼻腭神经阻滞麻醉
D. 舌神经阻滞麻醉
E. 腭前神经阻滞麻醉

正确答案：D。舌神经阻滞麻醉

解析：舌神经阻滞麻醉区域：同侧下颌舌侧牙龈、黏骨膜、口底黏膜及舌前2/3部分。掌握“颌面部常用局麻法及牙拔除的麻醉选择”知识点。